某外科医师擅用西黄丸，此中成药的主治病证有
A. 痈疽
B. 疔毒
C. 瘰疬
D. 流注
E. 癌肿

正确答案：A、B、C、D、E。痈疽；疔毒；瘰疬；流注；癌肿

解析：本题考查的是西黄丸的主治。某外科医师擅用西黄丸，此中成药的主治病证有痈疽（A对）、疔毒（B对）、瘰疬（C对）、流注（D对）与癌肿（E对）。西黄丸：【主治】热毒壅结所致的痈疽疔毒、瘰疬、流注、癌肿。